来源于横断面观察，以获得的某年（或某一时期内）所有年龄组死亡率为已知数据编制的寿命表称为
A. 寿命表
B. 定群寿命表
C. 现时寿命表
D. 完全寿命表
E. 简略寿命表

正确答案：C。现时寿命表

解析：本题考查现时寿命表的数据来源。现时寿命表（C对ABDE错）的数据来源于横断面观察，以获得的某年（或某一时期内）所有年龄组死亡率为已知数据。